食物特殊动力作用效应最大的食物是
A. 糖
B. 脂肪
C. 蛋白质
D. 维生素
E. 混合食物

正确答案：C。蛋白质